患者20岁，10分钟前外伤，上前牙脱落，要求治疗。查：左上1完全脱位，左上2右上1牙冠完整，叩（±），松（-），该患者应如何处理
A. 立即再植固定，定期观察
B. 脱落牙牙髓治疗后，复位再植固定
C. 复位固定4周后，牙髓治疗
D. 嘱患者伤口愈合后修复
E. 立即修复

正确答案：C。复位固定4周后，牙髓治疗

解析：本题考查牙脱位的治疗。患者20岁，10分钟前外伤，上前牙脱落，要求治疗。查：左上1完全脱位，左上2右上1牙冠完整，叩（±），松（-），该患者应复位固定4周后，牙髓治疗（C对A错）。患者20岁，10分钟前外伤，右上1完全脱位，左上2右上1牙冠完整，对于完全脱位在0.5小时内的成年患牙，需及时复位，术后3～4周再行根管治疗。牙完全脱位2小时以后再就诊者，牙髓和牙周膜已经坏死，应在体外进行根管治疗术，并经根面和牙槽窝刮治后，将患牙植入、固定（B错）。患牙满足再植条件，且再植后能避免牙根吸收的概率较高，暂不需要行修复治疗（DE错）。